对于流行病学实验研究对象的选择，下面哪项不正确
A. 流行病学实验研究应选择依从性好的人群
B. 在新药临床试验时，应将老年人、儿童及孕妇等除外
C. 在做药物临床试验时，不应选择流动性强的人群
D. 要评价甲肝疫苗的效果，可以选择新近有甲肝流行
E. 要评价食用盐中加碘是否能有效预防地方性甲状腺肿，可以选择缺碘的内陆地区

正确答案：D。要评价甲肝疫苗的效果，可以选择新近有甲肝流行